某女，55岁。素体虚弱，近日因感受风寒而致恶寒发热、头痛鼻塞、咳嗽痰多、胸闷呕逆、乏力气短。宜选用的成药是
A. 保济丸
B. 荆防颗粒
C. 参苓白术颗粒
D. 参苏丸
E. 玉屏风颗粒

正确答案：D。参苏丸

解析：本题考查的是参苏丸的主治。素体虚弱，近日因感受风寒而致恶寒发热、头痛鼻塞、咳嗽痰多、胸闷呕逆、乏力气短。宜选用的成药是参苏丸（D对）。参苏丸：【主治】身体虚弱，感受风寒所致的感冒，症见恶寒发热、头痛鼻塞、咳嗽痰多、胸闷呕逆、乏力气短。保济丸（A错）：【主治】暑湿感冒，症见发热头痛、腹痛腹泻、恶心呕吐、肠胃不适；亦可用于晕车晕船。荆防颗粒（B错）：【主治】外感风寒挟湿所致的感冒，症见头身疼痛、恶寒无汗、鼻塞流涕、咳嗽。参苓白术颗粒（C错）：【主治】脾胃虚弱，食少便溏，气短咳嗽，肢倦乏力。玉屏风颗粒（E错）：【主治】表虚不固所致的自汗，症见自汗恶风、面色㿠白，或体虚易感风邪者。